25岁已婚妇女，停经50天诊为早孕，要求行负压吸宫术。术中出现恶心呕吐、出汗，查体面色苍白，血压70/50mmHg，心率48次/分。本例最可能的诊断是
A. HELLP综合征
B. Turner综合征
C. Sheehan综合征
D. 宫腔粘连综合征
E. 人工流产综合反应

正确答案：E。人工流产综合反应

解析：该患者为已婚女性，在负压吸宫术中出现恶心呕吐、出汗，面色苍白，血压下降，心动过缓（人工流产综合反应指受术者在术中或术毕出现恶心呕吐、心动过缓、心律不齐、面色苍白、头昏、胸闷、大汗淋漓，严重者甚至出现血压下降、昏厥、抽搐等迷走神经兴奋症状），最可能的诊断是人工流产综合反应（E对）。HELLP综合征（P71）（A错）以溶血、肝酶升高及血小板减少为特点，常危及母儿生命，但无恶心呕吐、出汗，面色苍白，血压下降等症状。Turner综合征（P353）（B错）又称特纳综合征，临床特点为身矮、生殖器与第二性征不发育和一组躯体的发育异常，伴原发性闭经。Sheehan综合征（P354）（C错）又称希恩综合征，为垂体性闭经的一种类型，是由于产后大出血休克，导致腺垂体促性腺激素分泌细胞缺血坏死，临床表现为闭经、无泌乳、第二性征衰退等腺垂体功能低下症状。宫腔粘连综合征（P354）（D错）为子宫性闭经的常见原因，多因人工流产刮宫过度或产后、流产后出血刮宫损伤子宫内膜，导致宫腔粘连而闭经，无恶心呕吐、出汗，面色苍白，血压下降等症状。